68岁，胃部大手术，口腔黏膜刺激痛2月，双侧舌背黏膜片状充血，丝状乳头萎缩。检查
A. 活体组织检查
B. 唾液流量
C. 血细胞
D. 脱落细胞
E. 免疫学

正确答案：C。血细胞

解析：本题考查地图舌的临床检查。地图舌的诊断常借助于血细胞检查（C对）。地图舌可根据舌背、舌尖、舌缘等部位的典型地图样改变及其不断变化的游走特征进行诊断。一般不需要进行病理检查（A错）。唾液流量（B错）检查、脱落细胞（D错）检查、免疫学（E错）检查均不是地图舌的临床检查方法。